关于血红蛋白合成的叙述正确的是
A. 血红素合成以甘氨酸、天冬氨酸为原料
B. 血红素合成只有在成熟红细胞才能进行
C. 血红蛋白合成与珠蛋白合成无关
D. 受肾分泌的红细胞生成素调节
E. 合成全过程仅受ALA合酶的调节

正确答案：D。受肾分泌的红细胞生成素调节